男，55岁，间歇性跛行伴右小腿腓肠肌疼痛一年余，查体右小腿以下皮肤粗糙，萎缩，变薄发亮，右足背动脉搏动消失，为明确治疗方案，最有意义的检查
A. 多普勒超声
B. 阶段性电抗阻和光电容积描述
C. MRI血管成像
D. 动脉造影
E. 阶段性动脉压测定

正确答案：D。动脉造影

解析：中年男性患者（年龄＞45岁），间歇性跛行伴右小腿腓肠肌疼痛一年余（肢体慢性缺血表现），查体右小腿以下皮肤粗糙，萎缩，变薄发亮，右足背动脉搏动消失（动脉阻塞体征），故患者怀疑动脉硬化性闭塞症，因为动脉造影能显示动脉狭窄或闭塞的部位、范围、侧支及阻塞远侧动脉主干的情况，以确定诊断，指导治疗，故最有意义的检查为动脉造影（D对）。多普勒超声一般用于判断血流强弱、阻塞情况、管壁厚度、狭窄程度、有无附壁血栓及测定流速等，但不是确定诊断首选检查（A错）。电阻抗体积描记检查一般用于判断下肢静脉通畅度，以确定有无静脉血栓形成（B错）。MRI血管成像相对于动脉造影而言价格较为昂贵，不作为此处首选检查（C错）。阶段性动脉压测定一般是用于抢救低心排血量综合征和心源性休克的重要手段（E错）。